与紧密结合临床有关的药物信息包括
A. 答复药物配伍禁忌方面的咨询
B. 介绍新药并且宣传药品动态
C. 对食品和保健品的评价
D. 编写《药讯》和本单位的《处方集》
E. 介绍药物研究中分析方法的资料

正确答案：A、B、D。答复药物配伍禁忌方面的咨询；介绍新药并且宣传药品动态；编写《药讯》和本单位的《处方集》